检测血液中哪种物质的浓度最能反映甲状腺功能
A. 促甲状腺激素
B. 结合型甲状腺激素
C. 游离型甲状腺激素
D. 甲状腺结合球蛋白
E. 甲状腺球蛋白

正确答案：C。游离型甲状腺激素